右归丸的功用是
A. 温补肾阳,填精补血
B. 滋阴补肾,填精益髓
C. 温肾壮阳,涩精止遗
D. 温肾化气,利水消肿
E. 温补肾阳,涩精缩尿

正确答案：A。温补肾阳,填精补血

解析：方中附子、肉桂、鹿角胶培补肾中元阳，温里祛寒，为君药。 熟地黄、山萸肉、枸杞子、山药滋阴益肾，养肝补脾，填精补髓，取“阴中求阳”之义， 为臣药。再用菟丝子、杜仲补肝肾、强腰膝，配以当归养血和血，共补肝肾精血，为佐药,诸药合用，具有温补肾阳,填精补血的功效（A对）。滋阴补肾,填精益髓为左归丸的功用（B错）。温肾壮阳,涩精止遗为金锁固金丸的功用（C错）。温肾化气,利水消肿为加味肾气丸的功用（D错）。温补肾阳,涩精缩尿为缩泉丸的功用（E错）。